下列各项，不属于月经病主要病因的是
A. 寒热湿邪
B. 房劳多产
C. 内伤七情
D. 营卫不调
E. 体质因素

正确答案：D。营卫不调

解析：风邪自表而入，可引起营卫失和，其表现为头痛发热，汗出恶风、鼻鸣干呕、脉浮弱、苔白滑、口不渴等症。营卫不调不是月经病的病因（D对）。月经病的病因主要是寒热湿邪侵袭（A错）、情志因素（C错）、房室所伤（B错）、饮食失宜、劳倦过度和体质因素（E错）。